拔牙后第3天，拔牙区剧烈疼痛并向耳颈部放射，检查张口正常，牙槽窝空虚，并覆盖有白色假膜，可能原因是
A. 间隙感染
B. 牙槽脓肿
C. 干槽症
D. 三叉神经痛
E. 神经损伤

正确答案：C。干槽症

解析：本题考查干槽症。拔牙后第3天，拔牙区剧烈疼痛并向耳颈部放射，检查张口正常，牙槽窝空虚，并覆盖有白色假膜，可能原因是干槽症（C对）。根据题目中的信息拔牙后第3天，拔牙区剧烈疼痛并向耳颈部放射，牙槽窝空虚，可推测为干槽症。间隙感染一般表现为红肿热痛、张口受限及吞咽困难，严重者可伴有全身症状（A错）；牙槽脓肿表现为咬合痛、叩痛及牙齿松动等，患牙可见龋坏、充填体或其他牙体硬组织疾患（B错）；神经损伤可伴有对应神经支配的区域反射异常（E错）；三叉神经痛一般表现为针刺样、刀割样、电击样剧烈疼痛，由扳机点引起，为间歇性疼痛（D错）。